最难发生酸水解的是
A. 毛茛苷
B. 藏红花苦苷
C. 芦荟苷
D. 腺苷
E. 鸟苷

正确答案：C。芦荟苷

解析：本题考查的是苷类化合物的理化性质。最难发生酸水解的是芦荟苷（C对）。按苷键原子不同，酸水解的易难顺序为：N-苷＞O-苷＞S-苷＞C-苷。毛茛苷（A错）与藏红花苦苷（B错）为O-苷、腺苷（D错）和鸟苷（E错）为N-苷，芦荟苷是C-苷，因此芦荟苷最难发生酸水解。